日本人及瑞典人红细胞中缺乏或基本没有过氧化氢酶，因此对过氧化氢解毒能力低
A. 实验动物的物种与毒效应
B. 实验动物的品系与毒效应
C. 实验动物的性别与毒效应
D. 实验动物的年龄与毒效应
E. 实验动物的生理营养状况与毒效应

正确答案：B。实验动物的品系与毒效应